女，18岁。间断排黏液脓血便伴发热2个月。每天大便10余次。体温波动在38.0~39.5℃，广谱抗生素治疗1周后症状无好转。结肠镜检查全结肠弥漫性充血、糜烂，伴溃疡形成。首选的治疗药物是
A. 美沙拉嗪
B. 硫唑嘌呤
C. 泼尼松
D. 异烟肼
E. 蒙脱石散

正确答案：C。泼尼松

解析：青少年女性患者。间断排黏液脓血便（溃疡型结肠炎的典型表现）伴发热2个月。每天大便10余次（＞6次/日，属于重度）。体温波动在38.0~39.5℃（＞37.8℃，属于重度），广谱抗生素治疗1周后症状无好转。结肠镜检查全结肠弥漫性充血、糜烂，伴溃疡形成（提示溃疡型结肠炎），故结合患者的症状、体征和实验室检查，其最可能的诊断是重型溃疡性性结肠炎，故首选的治疗药物是波尼松（C对）。美沙拉嗪（A错）是5-ASA制剂，一般适用于轻度回（小肠）结肠型及轻度结肠型患者。硫唑嘌呤（B错）一般用于治疗白血病、溶血性贫血、特发性血小板减少性紫癞等疾病。异烟肼（D错）一般用于治疗肺结核。蒙脱石散（E错）一般用于成人及儿童急、慢性腹泻，食道、胃、十二指肠疾病引起的相关疼痛症状的辅助治疗。